属于医学伦理学基本范畴的是
A. 公正
B. 权利
C. 廉洁奉公
D. 医德评价
E. 医患关系

正确答案：B。权利

解析：医德范畴即医学伦理学基本范畴，是一般道德范畴与医学实践相结合的产物，是一般道德范畴在医学职业中的具体应用，也是对医德实践的概括和总结。医学伦理学基本范畴包括：权利（B对）与义务、情感与理智、审慎与胆识、良心与荣誉。廉洁奉公（C错）属于医学伦理学基本规范。